女，2个月。顽固性便秘伴有腹胀，呕吐，营养不良，首先考虑的诊断是
A. 先天性巨结肠
B. 幽门痉挛
C. 胃食管反流病
D. 胃扭转
E. 先天性肥厚性幽门梗阻

正确答案：A。先天性巨结肠

解析：婴儿顽固性便秘，腹胀，呕吐，营养不良（先天性巨结肠典型表现），故首先考虑的诊断是先天性巨结肠（A对）。幽门痉挛主要症状为呕吐，呕吐物量多、有酸臭味，并有宿食（B错）。胃食管反流病一般有嗳气、反酸、烧心等症状（C错）。胃扭转典型三联征为突然发生的严重而短暂的胸部或上腹部疼痛、持续性的干呕、很少或无呕吐物、难以插入胃管（D错）。先天性肥厚性幽门梗阻以呕吐主要症状，开始为溢乳，逐日加重呈喷射性呕吐，几乎每次喂奶后均吐，多于喂奶后不到半小时即吐，自口鼻涌出。吐出物为带凝块的奶汁，不含胆汁，患儿呕吐后即饥饿欲食（E错）。